疾病监测采用的方法属于
A. 描述性研究
B. 分析性研究
C. 理论性研究
D. 包括以上三种

正确答案：A。描述性研究

解析：本题考查疾病监测采用的方法。疾病监测采用的方法属于描述性研究（A对BCD错），描述与健康相关事件的分布特征和变化趋势。